月经经期正常，经量增多伴神疲体倦，气短懒言，治疗宜用
A. 参苓白术散
B. 补中益气汤
C. 举元煎
D. 理中丸
E. 归脾丸

正确答案：C。举元煎

解析：月经经期正常，经量增多可诊断为月经过多；又根据“神疲体倦，气短懒言”判断为气虚证。气虚冲任不固，经血失于制约，故经行量多；气虚中阳不振，故神疲体倦，气短懒言。治法为补气摄血固冲，方药为举元煎（C对）。